效度是指
A. 测器的稳定性
B. 测器的可靠性
C. 测器的准则
D. 与研究目的的准确度
E. 以上都是

正确答案：D。与研究目的的准确度

解析：本题考查效度。效度是指测量结果与试图要达到的目标之间的接近程度，即与研究目的的准确度（D对ABCE错）。